刺激性皮炎最容易出现在化妆品
A. 首次使用时
B. 首次使用后
C. 反复直接接触后
D. 间断接触后
E. 偶尔使用时

正确答案：C。反复直接接触后

解析：本题考查刺激性皮炎的发病时间。刺激性皮炎一般指原发性刺激性接触性皮炎，简称为刺激性接触性皮炎，是指皮肤接触刺激物质后，由原发性刺激性作用引起的一种非变应性炎症反应。最容易出现在化妆品反复直接接触后（C对ABDE错）。